某地区成年人的首位死因是心脏病，下列各项措施中不属于该地区优先防治策略的是
A. 通过媒体倡导居民增加身体活动
B. 在社区人群中开展减少心脏病危险因素的咨询
C. 加强公共场所与工作场所的控烟
D. 大力发展心脏专科医院，为病人提供心脏介入治疗
E. 以高胆固醇血症和家族史为指标

正确答案：D。大力发展心脏专科医院，为病人提供心脏介入治疗

解析：在心脏病预防与管理过程中医院以及相关机构和临床医生应为病人提供优质的治疗服务，发展心脏专科医院，为病人提供心脏介入治疗（D错，为本题正确答案）属于治疗服务，并不属于地区预防策略。通过媒体倡导居民增加身体活动（A对）、在社区人群中开展减少心脏病危险因素的咨询（B对）、加强公共场所与工作场所的控烟（C对）、以高胆固醇血症和家族史为指标，确定高危人群，然后做适当干预（E对）等都属于减少心脏病发病的高危因素，也都属于地区优先防治策略中的一部分。